男性，43岁，在工地从高处坠落昏迷，工友送至附近医院抢救，接诊医生全力抢救，未及时书写病历，抢救结束后，接诊医生在规定时限之内据实补记病历，请问该时限为
A. 2小时
B. 4小时
C. 6小时
D. 8小时
E. 12小时

正确答案：C。6小时

解析：因抢救急危病人，未能及时书写病历的，有关医务人员应当在抢救结束后6小时内据实补记，并加以注明（C对）。